制定健康教育具体目标的4个W包括的内容是
A. 何人、何种行为、多大程度、在哪里
B. 何人、何种行为、何地、变化程度
C. 何人、何种行为、何时、在哪里
D. 何人、多大程度、何时、如何测量
E. 何人、何时、何地、变化程度

正确答案：C。何人、何种行为、何时、在哪里